胃蛋白酶水解的片段是
A. 2Fab段﹢Fc段
B. F（ab'）2 ﹢pFC'
C. 绞链区
D. 可变区
E. 稳定区

正确答案：B。F（ab'）2 ﹢pFC'